风湿性心脏瓣膜病患者，症见心悸盜汗，心烦不寐，两颧发红，干咳带血，舌红少苔，脉细数。其证型是
A. 心阴不足
B. 心阳不足
C. 心肾阳虚
D. 气虚血瘀
E. 水气凌心射肺

正确答案：A。心阴不足

解析：风湿性心脏瓣膜病患者，症见心悸盜汗，为阴虚所致；心烦不寐，两颧发红，多为阴虚生热之虚热的表现；干咳带血，舌红少苔，脉细数，均为心阴不足的表现（A对）。心阳不足，症见心悸，困倦，乏力少气，形寒肢冷等（B错）。心肾阳虚证，症见心悸喘促，不能平卧，四肢浮肿，形寒肢冷，便溏尿少，舌淡苔白（C错）。气虚血瘀证，症见呼心慌，倦怠乏力，汗出，舌淡紫，脉沉细微无力等（D错）。水气凌心射肺，症见心悸咳喘，气短息粗，咳痰色白等（E错）。